颧弓骨折复位的指征是
A. 鼻孔出血
B. 咀嚼无力
C. 骨折区疼痛
D. 张口受限
E. 患者要求治疗

正确答案：D。张口受限

解析：颧骨、颧弓骨折后，如仅有轻度移位，畸形不明显，无张口受限、复视及神经受压等功能障碍者，可作保守治疗。凡有塌陷畸形、张口受限、复视者均为手术适应证。虽无功能障碍但有明显畸形者也可考虑手术复位内固定。掌握“颧骨及颧弓、眼眶骨折及骨折愈合过程”知识点。